WHO在1991年的一项调查中显示，行为生活方式占死亡原因的
A. 0.3
B. 0.4
C. 0.5
D. 0.6
E. 0.7

正确答案：D。0.6